关于真菌孢子的描述，错误的是
A. 抵抗力不如细菌芽胞强
B. 一条菌丝可形成多个孢子
C. 真菌孢子的抵抗力强
D. 一个细菌只产生一个芽胞，并且不是繁殖体
E. 大多数致病性真菌属于有隔菌丝，无性孢子

正确答案：C。真菌孢子的抵抗力强

解析：真菌孢子与细菌芽胞不同，真菌孢子的抵抗力不强，60～70℃数分钟可杀灭。一条菌丝可形成多个孢子，是一种繁殖方式。细菌芽胞的抵抗力强，100℃煮沸数小时可不被杀灭。一个细菌只产生一个芽胞，并且不是繁殖体。大多数致病性真菌属于有隔菌丝，无性孢子。掌握“真菌概述及主要病原性真菌”知识点。